不符合急性单纯性阑尾炎表现的是
A. 均有局部腹肌紧张
B. 右下腹局限性轻度反跳痛
C. 有低热表现
D. 白细胞计数轻度升高
E. 右下腹局限性压痛

正确答案：A。均有局部腹肌紧张

解析：腹肌紧张是腹壁对炎症刺激的反应性痉挛。急性单纯性阑尾炎时，病变多只限于黏膜和黏膜下层，浆膜层可有少量炎性渗出，炎症累及壁层腹膜时，可出现右下腹局限性压痛（E对）、轻度反跳痛（B对）和局部腹肌紧张，但小儿、孕妇、老人、盲肠后位阑尾炎时，可无局部腹肌紧张（A错，为本题正确答案）。急性单纯性阑尾炎时，全身感染症状一般较轻，可有低热（C对）、白细胞轻度升高（D对）等表现。